某女，55岁，患冠心病室性早搏3年，症见心悸不安，气短乏力，动则加剧，胸部闷痛，失眠多梦，盗汗，神倦，懒言，医师处以参松养心胶囊，服后症状得到控制。此因该成药除活血通络外，又能
A. 益气强心，清心安神
B. 益气复脉，养阴生津
C. 益气养阴，清心安神
D. 益气强心，养阴生津
E. 益气复脉，平肝安神

正确答案：C。益气养阴，清心安神

解析：本题考查的是参松养心胶囊的功能。参松养心胶囊除活血通络外，又能参松养心胶囊（C对）。参松养心胶囊：【功能】益气养阴，活血通络，清心安神。生脉饮：【功能】益气复脉，养阴生津（B错）。功能为益气强心，清心安神（A错）、益气强心，养阴生津（D错）或益气养阴，平肝安神（E错）的中成药，2022年考试指南未明确说明。